以下年轻恒牙活髓保存成功的因素是
A. 无痛
B. 动作轻柔
C. 去净腐质
D. 无菌操作
E. 充分止血

正确答案：D。无菌操作

解析：活髓保存治疗包括盖髓术和切髓术。直接、间接盖髓术可以保存全部活髓，全部或部分活髓切断术可以保存部分活髓。临床上常用的盖髓药物为氢氧化钙类制剂。MTA也可以应用。年轻恒牙氢氧化钙冠髓切断术可以保留根部活髓，使牙根继续发育。但应密切复查，观察钙化桥的形成，有无牙根内外吸收，有无根管钙变。年轻恒牙活髓保存成功的因素是：诊断明确；治疗中无菌操作，尽量减少创伤；严密充填窝洞，预防微渗漏的发生；定期复查。掌握“年轻恒牙牙髓病及根尖周病诊断及治疗”知识点。